骨囊肿的典型X线表现是
A. 葱皮样骨膜反应
B. 骨质破坏，死骨形成
C. 日光放射状骨膜反应
D. 肥皂泡样骨质反应
E. 干骺端圆形边界清楚的溶骨性病灶

正确答案：E。干骺端圆形边界清楚的溶骨性病灶

解析：骨囊肿的典型X线表现是干骺端圆形边界清楚的溶骨性病灶（E对）。葱皮样骨膜反应（A错）是尤因肉瘤的典型X线表现。骨质破坏，死骨形成（B错）是慢性血源性骨髓炎的典型X线表现。日光放射状骨膜反应（C错）是骨肉瘤的典型X线表现。肥皂泡样骨质反应（D错）是骨巨细胞瘤的典型X线表现。